蕲蛇药材性状特征有
A. 翘鼻头
B. 方胜纹
C. 连珠斑
D. 尾部骤细
E. 佛指甲

正确答案：A、B、C、E。翘鼻头；方胜纹；连珠斑；佛指甲